阿托品禁用于
A. 青光眼患者
B. 高钙血症
C. 高磷血症
D. 乳腺癌
E. 高脂血症

正确答案：A。青光眼患者

解析：本题考查阿托品。阿托品为乙酰胆碱M受体阻断剂，具有扩瞳、升高眼内压作用，禁用于青光眼（A对）；高钙血症（B错）是指血清钙离子浓度的异常升高，一般血清钙≥2.75mmol/L（正常值为2.25～2.75mmol/L）为高钙血症；成人血磷值超过1.61mmol/L（正常成人血磷浓度为0.97～1.61mmol／L）即为高磷血症（C错）；乳腺癌（D错）是发生在乳腺上皮组织的恶性肿瘤；由于脂肪代谢或运转异常使血浆一种或多种脂质高于正常称为高脂血症（E错）。